完全抗原
A. 只有免疫原性，无抗原性
B. 只有抗原性，无免疫原性
C. 既无免疫原性，又无抗原性
D. 既有免疫原性，又有抗原性
E. 不能激发细胞免疫应答

正确答案：D。既有免疫原性，又有抗原性

解析：免疫原性是指能引起免疫应答的性能，即抗原能刺激特定的免疫细胞，使免疫细胞活化、 增殖、分化，最终产生免疫效应物质抗体和致敏淋巴细胞的特性。抗原性(又称免疫反应性)指抗原与其所诱导产生的抗体或致敏淋巴细胞特异性结合的能力。